关于DNA聚合酶的叙述，错误的是
A. 需模板DNA
B. 需引物RNA
C. 延伸方向为5'→3'
D. 以NTP为原料
E. 具有3'→5'外切酶活性

正确答案：D。以NTP为原料